肛裂三联征是指
A. 内痔，外痔，肛裂
B. 肛裂，内痔，前哨痔
C. 内痔，外痔，前哨痔
D. 肛裂，前哨痔，齿状线上乳头肥大
E. 肛裂，前哨痔，外痔

正确答案：D。肛裂，前哨痔，齿状线上乳头肥大

解析：肛裂慢性裂口上端的肛门瓣和肛乳头常水肿，形成肥大乳头；下端皮肤因炎症、水肿及静脉、淋巴回流受阻，形成袋状皮垂向下突出于肛门外，称为前哨痔（P398）。肛裂、前哨痔、齿状线上乳头肥大（D对）被称为肛裂“三联征”。内痔是肛垫的支持结构、静脉丛及动静脉吻合支发生病理性改变或移位（AB错）。外痔由齿状线远侧静脉丛的病理性扩张或血栓形成（CE错）。